女，45岁。G₂P₂，痛经15年，加重4年，应用止痛药物效果差。妇科检查：子宫后位，如孕3个月大小，质硬，压痛。双侧附件区未及明显异常。最可能的诊断是
A. 子宫肥大症
B. 子宫肉瘤
C. 子宫腺肌病
D. 子宫肌瘤
E. 子宫内膜异位症

正确答案：C。子宫腺肌病

解析：患者女，45岁。G₂P₂，痛经15年，加重4年，应用止痛药物效果差。妇科检查：子宫后位，如孕3个月大小，质硬，压痛。最可能诊断为子宫腺肌病(C对）。子宫肉瘤多见于老年妇女，生长迅速，多有腹痛，腹部包块及不规则阴道流血（B错）。子宫肌瘤多表现经量增多及经期延长，下腹包块，白带增多及压迫症状（D错）。子宫内膜异位症表现为生育年龄女性有继发性痛经且进行性加重，不孕或慢性盆腔痛，盆腔扪及与子宫相连的囊性包块或盆腔内有触痛性结节，即可初步诊断（E错）。子宫肥大症主要表现为白带增多。不会表现子宫后位，如孕3个月大小，质硬（A错）。